属于社区卫生服务特点的是
A. 以人群为对象
B. 提供综合服务
C. 以基层卫生保健为主要内容
D. 提供协调性服务
E. 以上均正确

正确答案：E。以上均正确

解析：以家庭为单位：家庭是组成社区的基本单元，家庭内每个成员之间有着密切的血缘和经济关系以及相似的行为、生活方式、居住环境、卫生习惯等。因此，在健康问题上存在着相同的危险因素。掌握“社区口腔卫生服务”知识点。